开口于下鼻道的结构
A. 咽鼓管咽口
B. 鼻泪管
C. 上颌窦
D. 额窦
E. 蝶窦

正确答案：B。鼻泪管

解析：鼻泪管开口于下鼻道（B对）。